维生素D缺乏性佝偻病发生颅骨软化的年龄多见于
A. 1～2个月
B. 3～6个月
C. 7～9个月
D. 10～12个月
E. 1～2岁

正确答案：B。3～6个月

解析：维生素D缺乏性佝偻病发生颅骨软化的年龄多见于3～6个月（B对）的患儿。1～2个月（A错）维生素D缺乏的小儿多表现为神经兴奋性增高的表现，如易激惹、烦闹等，但并非佝偻病的特异症状；7～9个月（C错）多见方颅；10～12个月（D错）可见肋骨串珠状改变；1～2岁（E错）可见“O”形腿或“X”形腿。